药用部位是种子的有
A. 桃仁
B. 沙苑子
C. 金樱子
D. 酸枣仁
E. 牵牛子

正确答案：A、B、D、E。桃仁；沙苑子；酸枣仁；牵牛子